正常成人血清钾浓度为
A. 1.5~2.5mmol/L
B. 2.5~3.5mmol/L
C. 3.0-5.5mmol/L
D. 4.5~5.5mmol/1,
E. 3.5~5.5mmol/L

正确答案：E。3.5~5.5mmol/L

解析：血清钾浓度的正常范围为3.5 ~5. 5mmol/L（E对），血清钾浓度低于3.5mmol/L称为低钾血症，血清钾浓度高于5.5mmol/L称为高钾血症。